A型行为的特点
A. 积极工作
B. 雄心勃勃
C. 争强好胜
D. 急躁易怒
E. 以上说法均正确

正确答案：E。以上说法均正确

解析：A型行为的特点：争强好胜，雄心勃勃，积极工作，而又急躁易怒，即具有时间紧迫感和竞争敌对倾向等特征。掌握“心身疾病”知识点。